腺源性感染最常见于
A. 咽旁间隙
B. 翼下颌间隙
C. 下颌下间隙
D. 舌下间隙
E. 颞下间隙

正确答案：C。下颌下间隙

解析：本题考查为腺源性感染的口腔颌面部的间隙感染。下颌下间隙（C对）感染常来自下颌智牙冠周炎、下颌后牙根尖周炎、牙槽脓肿等牙源性感染，或下颌下淋巴结炎扩散，最易产生腺源性感染。咽旁间隙（A错）感染多为牙源性，特别是下颌智牙冠周炎、腭扁桃体炎和相邻间隙感染的扩散。翼下颌间隙（B错）感染常来自下颌智牙冠周炎及下颌磨牙根尖周炎症扩散、下牙槽神经阻滞麻醉时消毒不严或拔下颌智齿时创伤过大、相邻间隙炎症等，以牙源性为主。舌下间隙（D错）感染多为下颌牙的牙源性感染，口底黏膜的损伤、溃疡及舌下腺、下颌下腺导管炎症引起。颞下间隙（E错）感染多为相邻间隙感染，上颌结节、卵圆孔、圆孔阻滞麻醉，上颌磨牙的根尖周感染或拔牙后感染引起。